一个工作日内，任何一次接触不得超过的15分钟时间加权平均的容许接触水平是指
A. 生物学接触限值
B. 时间加权平均容许浓度
C. 最高容许浓度
D. 阈限值
E. 短时间接触容许浓度

正确答案：E。短时间接触容许浓度